郁证中，肝气郁结的常用治法是
A. 健脾养心，补益气血
B. 健脾养心，理气化痰
C. 化痰散结，行气开郁
D. 理气畅中，疏肝解郁
E. 清肝化痰，疏肝解郁

正确答案：D。理气畅中，疏肝解郁

解析：本题考查的是郁证的辨证论治。郁证中，肝气郁结的常用治法是理气畅中，疏肝解郁（D对）。郁证是由于情志不舒，气机郁滞所致，以心情抑郁，情绪不宁，胸部满闷，胁肋胀痛，或易怒喜哭，或咽中如有异物梗塞等症为主要临床表现的疾病。西医学的神经衰弱、癔症、抑郁症、焦虑症或抑郁状态以及围绝经期综合征等有上述表现者，可参考此内容辨证论治。（一）肝气郁结证：【症状】精神抑郁，情绪不宁，胸部满闷，胁肋胀痛，痛无定处，胸闷嗳气，喜太息，不思饮食，大便不调，或秘或溏泄。舌苔薄或腻，脉弦。【治法】疏肝解郁，理气畅中。（二）痰气郁结证：【症状】精神抑郁，胸部闷塞，胁肋胀满，咽中如有物梗塞，咽之不下，咯之不出。舌苔白腻，脉弦滑。【治法】行气开郁，化瘀散结（C错）。（三）心神失养证：【症状】精神恍惚，心神不宁，多疑易惊，悲忧善哭，喜怒无常，或时时欠伸，或手舞足蹈，骂詈喊叫等。舌质淡，脉弦。【治法】甘润缓急，养心安神。（四）心脾两虚证：【症状】情绪不宁，多思善疑，头晕神疲，心悸胆怯，失眠健忘，食少纳呆，面色不华。舌质淡，苔薄白，脉细。【治法】健脾养心，补益气血（A错）。治法为健脾养心，理气化痰（B错）或清肝化痰，疏肝解郁（E错）的病证，2022年考试指南未明确说明。